关于急性乳腺炎酿脓期治疗方法的叙述，下列哪项是正确的
A. 切开引流
B. 乳房按摩
C. 穿刺排脓
D. 取芒硝热敷
E. 内服瓜萎牛蒡汤

正确答案：A。切开引流

解析：急性乳腺炎临床常分为三期：郁乳期、酿脓期、溃脓期。脓肿期的治疗原则为切开引流（A对）。推拿按摩（B错）适用于早期乳汁淤滞阶段。成脓若脓肿小而浅者，可用针吸穿刺抽脓（C错），并外敷金黄膏。早期和化脓阶段的急性乳腺炎使用热敷（D错），以促进炎症消散或脓肿快速形成。中医乳痈初期及郁乳期表现为气滞热壅证，治宜疏肝清胃、通乳消肿，方选瓜蒌牛蒡汤（E错）加减治疗。